关于盲肠和结肠形态的描述，错误的是
A. 均为大肠的一部分
B. 管径较小，壁较薄
C. 沿肠的纵轴排列有三条平行的结肠带
D. 肠壁上有结肠袋
E. 结肠带附近有脂肪垂

正确答案：B。管径较小，壁较薄

解析：盲肠和结肠都为大肠的一部分(A对)，盲肠是大肠最粗的一部分(B错，为本题正确答案)，沿大肠纵轴排列有三条平行结肠带(C对)，结肠袋、结肠带和肠脂垂为结肠和盲肠的特征性结构(D对)，结肠带两侧小突起为肠脂垂(E对)。